关于蒽醌类衍生物酸性强弱的说法，正确的是
A. 酚羟基越多，酸性越强
B. 氨基越多，酸性越强
C. 芳基越多，酸性越强
D. 甲基越多，酸性越强
E. 甲氧基越多，酸性越强

正确答案：A。酚羟基越多，酸性越强

解析：本题考查醌类化合物的理化性质。关于蒽醌类衍生物酸性强弱的说法，正确的是酚羟基越多，酸性越强（A对）。醌类化合物因分子中羧基的有无及酚羟基的数目与位置不同，表现出酸性的强弱差异。一般来说，含有羧基的醌类化合物的酸性强于不含羧基者，酚羟基数目增多则酸性增强，β-羟基醌类化合物的酸性强于α-羟基醌类化合物。单糖的伯或仲羟基被置换为氨基（B错），就成为基糖，如2-氨基-2-去氧-D-葡萄糖，天然氨基糖主要存在于动物和菌类中。环氧化物的水解：芳基（C错）和烯基的脂肪族碳氢化合物容易被氧化，生成环氧化物。